痛觉感受器为
A. Meckel环形小体
B. 克劳斯终球
C. 鲁非尼小体
D. 游离神经末梢
E. Meissner触觉小体

正确答案：D。游离神经末梢

解析：本题考查痛觉感受器。痛觉感受器为游离神经末梢（D对）。痛觉感受器是一种游离神经末梢，是传递伤害性或疼痛信号的初级感觉神经元的外周部分。热觉感受器为鲁菲尼小体（C错），冷觉感受器为克劳斯终球（B错）。口腔黏膜触压觉的感受器主要有四种：①游离神经末梢；②牙周膜本体感受器；③Meckel环形小体（A错）；④Meissner触觉小体（E错）。